下列各项，不属传染病学诊治工作道德要求的是
A. 重视消毒隔离
B. 强化社会预防保健意识
C. 应严格执行保密制度
D. 勇于献身的高尚道德情操
E. 严格疫情报告制度

正确答案：C。应严格执行保密制度

解析：传染病防控的伦理要求主要包括：1.严格执行隔离消毒措施和各项操作规程（A对）。2.坚持预防为主的积极防疫思想（B对）。3.尊重传染病患者的人格和权利。4.遵守国家法律规定，及时收集与上报疫情（E对）5.传染病科的医务人员要具有不畏艰险、无私奉献、热爱工作、忠于职守的良好品德和全心全意为患者服务的人道主义精神（D对）（C错，为本题正确答案）。